女，17岁。间断关节痛1个月，伴面部红斑，脱发和口腔溃疡。既往有日晒后皮肤瘙痒2年余。实验室检查：血Hb101g/L,WBC3.54×10⁹/L,PLT163×10⁹/L；尿常规（-）；ESR42mm/h;ANA(+），抗SSA抗体（+），血清C3降低。最可能的诊断是
A. 系统性红斑狼疮
B. 类风湿关节炎
C. 白塞病
D. 皮肌炎
E. 干燥综合征

正确答案：A。系统性红斑狼疮

解析：女，17岁。间断关节痛1个月，伴面部红斑，脱发和口腔溃疡。既往有日晒后皮肤瘙痒2年余（多系统病变）。实验室检查：血Hb101g/L，WBC3.54×10⁹/L，PLT163×10⁹/L；尿常规（-）；ESR42mm/h（正常女性0-20mm/h）；ANA(+)，抗SSA抗体（+），血清C3降低，综上考虑诊断为系统性红斑狼疮（A对）。类风湿关节炎（B错）多表现慢性的、外周对称性多关节肿痛，后期可出现关节畸形，类风湿因子阳性。白塞病（C错）是一种以口腔和外阴溃疡、眼炎为临床特征，并累及多个系统的慢性疾病，抗核抗体谱没有异常。皮肌炎（D错）是一种主要累及横纹肌，以淋巴细胞浸润为主的非化脓性炎症病变，以对称性肢带肌、颈肌及咽肌无力为特征。干燥综合征（E错）诊断有赖于口干燥症及干燥性角结膜炎的检测、抗SSA和（或）抗SSB抗体、唇腺灶性淋巴细胞浸润，后两项特异性较强。